尿浊的临床特点是
A. 发热，小便赤热，尿时灼痛
B. 排出砂石，排尿中断，腰腹绞痛
C. 小腹胀满，尿涩疼痛，余沥不尽
D. 小便混浊，白如泔浆，尿道不痛
E. 小便混浊，状如脂膏，尿热涩痛

正确答案：D。小便混浊，白如泔浆，尿道不痛

解析：尿浊是以小便浑浊，白如泔浆，尿时无涩痛不利感为主症的疾患（D对）。发热，小便赤热，尿时灼痛，是热淋的临床特点（A错）。排出砂石，排尿中断，腰腹绞痛，是石淋的临床特点(B错)。小腹胀满，尿涩疼痛，余沥不尽，是气淋的临床特点（C错）。小便混浊，状如脂膏，尿热涩痛，是膏淋的临床特点（E错）。